中风中经络出现语言謇涩，治疗除主穴外，还应选取的配穴是
A. 金津、玉液
B. 合谷、太冲
C. 悬钟、太冲
D. 合谷、颊车
E. 通里、哑门

正确答案：E。通里、哑门

解析：通里、哑门都可治疗语言謇涩，为最佳选项（E对）。金津、玉液主治口疮，舌强，舌肿，呕吐，消渴，起到滋阴的作用（A错）。中风中脏腑闭证配太冲、合谷（B错），悬钟、太冲用于下肢不遂等腰腿部疾患（C错）。颊车、合谷合用主要治疗面瘫（D错）。